AS04佐剂是
A. IL-1β和IL-18
B. 磷酸铝、氢氧化铝
C. MPL（减毒的脂多糖）和铝盐颗粒组成
D. 以角鲨烯（squalene）为油相的水包油乳化剂
E. 弗氏完全佐剂（CFA）和弗氏不完全佐剂（IFA）

正确答案：C。MPL（减毒的脂多糖）和铝盐颗粒组成

解析：AS04是MPL（减毒的脂多糖）和铝盐颗粒组成的佐剂。掌握“抗原基本概念、分类、超抗原及佐剂”知识点。